分子中含有烯丙基结构，具有阿片受体拮抗作用的药物是
A. 吗啡
B. 曲马多
C. 盐酸美沙酮
D. 盐酸哌替啶
E. 盐酸纳洛酮

正确答案：E。盐酸纳洛酮

解析：本题考查盐酸纳洛酮。分子中含有烯丙基结构，具有阿片受体拮抗作用的药物是盐酸纳洛酮（E对）。盐酸纳洛酮为阿片受体拮抗剂，分子中含有烯丙基结构，是将吗啡3位、6位羟基同时酯化，再将N-甲基用烯丙基取代得到的。吗啡（A错）是具有菲环结构的生物碱，有酚羟基和甲基叔胺基团；曲马多（B错）是其他合成镇痛药，是微弱的μ阿片受体激动剂，分子中有两个手性中心，临床用其外消旋体；盐酸美沙酮（C错）为氨基酮类镇痛药，分子中含有氨基酮结构。哌替啶（D错）是哌啶类镇痛药，分子结构中含有哌啶环和酯羰基。